哪项不属于预防接种后的异常反应
A. 接种部位的红肿24小时后消失
B. 癔病发作
C. 血清病
D. 过敏性休克
E. 晕厥

正确答案：A。接种部位的红肿24小时后消失

解析：本题考查预防接种的异常反应。异常反应是指合格的疫苗在实施规范接种过程中或者实施规范接种后造成受种者机体组织器官、功能损害，相关各方均无过错的药品不良反应。如癔病发作（B对）、血清病（C对）、过敏性休克（D对）、晕厥（E对）、过敏性喉头水肿、过敏性紫癜、血小板减少性紫癜、局部过敏坏死反应、脑病、脑炎和脑膜炎等。接种部位的红肿24小时后消失（A错，为本题正确答案）属于预防接种后的一般反应。